鹿衔草不具有的功效是
A. 活血通络
B. 祛风除湿
C. 强筋健骨
D. 调经止血
E. 补肺止咳

正确答案：A。活血通络

解析：本题考查鹿衔草的功效。鹿衔草不具有的功效是活血通络（A错，为本题正确答案）。鹿衔草【功效】祛风湿（B对），强筋骨（C对），调经止血（D对），补肺止咳（E对）。